泌尿系肿瘤血尿是
A. 无痛性肉眼血尿
B. 终末血尿伴膀胱刺激症状
C. 初始血尿
D. 疼痛伴血尿
E. 血尿+蛋白尿

正确答案：A。无痛性肉眼血尿

解析：泌尿系肿瘤血尿是多为全程无痛性肉眼血尿（A对）。终末血尿伴膀胱刺激症状（B错）为泌尿系结核的典型表现。初始血尿（C错）多见于后尿道、膀胱颈部出血。疼痛伴血尿（D错）多见于尿路结石。血尿+蛋白尿（E错）常见于肾小球肾炎。